有关慢性复发性腮腺炎早期发展到中期的叙述中，错误的是
A. 巨细胞浸润
B. 结缔组织纤维化
C. 病变晚期腺小叶被小叶间导管组织及结缔组织所替代
D. 导管周围炎症反应明显
E. 导管上皮出现退行性变

正确答案：C。病变晚期腺小叶被小叶间导管组织及结缔组织所替代

解析：组织病理学检查显示，病变早期，主要为导管系统病变，闰管、纹管及小叶间导管轻度扩张，管腔内含浓缩的黏液分泌物及脱落的导管上皮，炎症细胞少见。病变中期，导管周围炎症反应明显，结缔组织纤维化，淋巴细胞、组织细胞及巨细胞浸润。近腺体段导管明显扩张，导管上皮出现退行性变。病变晚期，腺小叶结构逐渐破坏，被增殖的间质脂肪及结缔组织所替代。终末导管增生，严重者萎缩的腺小叶完全由增生的导管、结缔组织及脂肪组织所替代。掌握“慢性复发性腮腺炎”知识点。